人体某些疾病的自愈体现的阴阳关系是
A. 阴平阳秘
B. 阴阳自和
C. 阴阳互藏
D. 阴阳协调
E. 阴阳平衡

正确答案：B。阴阳自和

解析：阴阳自和的概念，脱胎于中国古代哲学中“以和为贵”的基本观点，重视阴阳之间的和合、协调是阴阳学说的重要思想。如《淮南子》说：“天地之气，莫大于和。和者，阴阳调…阴阳相接，乃能成和。”阴阳二气的协调就是“和”，阴阳二气相互维系才能达到“和”的状态。阴阳自和所维持的动态平衡，在自然界标志着气候的正常变化，四时寒暑的正常更替，在人体标志着生命活动的稳定、有序、协调。故《素问》说“阴阳匀平，以充其形。九候若一，命曰平人。”由于人体内的阴阳二气具有自身调节的能力，在疾病过程中，人体阴阳自动恢复协调是促使病势向愈的内在机制（B对）。